下列哪项不是胃溃疡的病理特点
A. 周边粘膜充血水肿
B. 表面可有炎性渗出物
C. 可见坏死组织
D. 可见肉芽组织
E. 底部可见异型细胞

正确答案：E。底部可见异型细胞

解析：消化性溃疡是一种全球性常见病，十二指肠溃疡多于胃溃疡，十二指肠溃疡见于青壮年，胃溃疡多见于中老年人。胃溃疡多发生于胃角及胃窦小弯侧，周围黏膜常有充血水肿（A对），表面有炎性渗出物（B对），底部有肉芽组织（D对），溃疡深者可累及浆膜层易引起穿孔,可见坏死组织（C对）。异型细胞出现在肿瘤组织和细胞内，不属于胃溃疡的病理特点（E错，为本题正确答案）。